慢性支气管炎的病变不包括下列哪项
A. 黏膜上皮鳞状化生
B. 支气管腺体和杯状细胞增生
C. 支气管内有大量泡沫细胞
D. 支气管壁有大量慢性炎症细胞浸润
E. 支气管软骨变性、萎缩

正确答案：C。支气管内有大量泡沫细胞

解析：泡沫细胞是动脉粥样硬化斑块内出现的特征性病理细胞，与慢性支气管炎无关（C错，为本题正确答案）。慢性支气管炎的病变主要包括呼吸道黏液-纤毛排送系统受损，纤毛柱状上皮变性、坏死脱落，并发生鳞状上皮化生（A对）。支气管腺体和杯状细胞增生（B对），导致分泌黏液增多。管壁充血水肿，支气管壁有大量慢性炎症细胞浸润（D对）。管壁平滑肌断裂萎缩（喘息型者，平滑肌束增生肥大），支气管软骨可变性萎缩骨化（E对）。